下列有关剂量的概念，错误的是
A. 暴露剂量表示个人或人群暴露的化学物的量
B. 实验动物的暴露剂量称为给予剂量
C. 内剂量为经吸收到机体血流的化学物的量
D. 靶器官剂量也称为送达剂量或生物有效剂量
E. 剂量-反应关系中的剂量指的是靶器官剂量

正确答案：E。剂量-反应关系中的剂量指的是靶器官剂量